患者，女，61岁，体检发现重度骨质疏松，既往患有食管裂孔疝、高血压、2型糖尿病。长期服用奥美拉唑肠溶片、厄贝沙坦-氢氯噻嗪片，氨氯地平片、阿卡波糖片、阿司匹林肠溶片。实验室检查结果：肝、肾功能正常。该患者服用的药物中，可能与导致骨质疏松相关的是
A. 奥美拉唑肠溶片
B. 厄贝沙坦-氢氯噻嗪片
C. 阿卡波糖片
D. 阿司匹林肠溶片
E. 氨氯地平片

正确答案：A。奥美拉唑肠溶片

解析：本题考查抑酸药物的用药注意事项与患者教育。长期使用较高剂量PPI（A对）可使骨折风险升高，尤其是老年患者；对于需要维持用药的患者，应采用最低有效剂量，根据病情采用长期维持或按需给药。